大量失血时，可出现的反应是
A. 脑和心脏的血管收缩
B. 循环血液中儿茶酚胺减少
C. 外周阻力降低
D. 外周阻力增加
E. 肾脏排出Na+增多

正确答案：D。外周阻力增加